患者，女性，34岁。童年时有关节疼痛史，近一年来时常感到心悸易倦，查体心尖搏动向左移位，叩诊呈梨型心，心尖部可听到舒张期隆隆样杂音，其诊断为
A. 病毒性心肌炎
B. 风湿性心肌炎
C. 房间隔缺损
D. 风心病二尖瓣狭窄
E. 风心病二尖瓣关闭不全

正确答案：D。风心病二尖瓣狭窄

解析：患者童年时有关节疼痛史，有类风湿病史，近一年来时常感到心悸易倦，查体心尖搏动向左移位，叩诊呈梨型心，心尖部可听到舒张期隆隆样杂音，可诊断为风心病二尖瓣狭窄（D对）。病毒性心肌炎（A错）初期表现为发热，咽痛，腹泻，全身酸痛，然后出现心悸心慌、胸闷胸痛、倦怠乏力等。风湿性心肌炎（B错）有链球菌感染史，常有心脏杂音，可有关节疼痛、环形红斑、皮下结节、舞蹈病。房间隔缺损（C错）的特点为气促、乏力、心力衰竭等症状及胸骨左缘的收缩期杂音与肥厚型心肌病相似。风心病二尖瓣关闭不全（E错）心尖区可闻及Ⅲ级以上粗糙全收缩期杂音伴左房、左室增大。